4’-氧取代的异黄酮的¹H-NMR特征是
A. H-2’，H-6’的化学位移为7.10-7.30（d）
B. H-2’，H-6’的化学位移为7.20-7.50（d）
C. H-2’，H-6’的化学位移为7.60-7.80（d）
D. H-2’，H-6’的化学位移为7.70-7.90（d）
E. H-2’，H-6’的化学位移为7.90-8.10（d）

正确答案：B。H-2’，H-6’的化学位移为7.20-7.50（d）

解析：本题考查的是黄酮类化合物的核磁共振谱特征。4’-氧取代的异黄酮的¹H-NMR特征是H-2’，H-6’的化学位移为7.20-7.50（d）（B对）。4’-氧取代的二氢黄酮的¹H-NMR特征是H-2’，H-6’的化学位移为7.10-7.30（d）（A错）。4’-氧取代的橙酮的¹H-NMR特征是H-2’，H-6’的化学位移为7.60-7.80（d）（C错）。4’-氧取代的黄酮的¹H-NMR特征是H-2’，H-6’的化学位移为7.70-7.90（d）（D错）。4’-氧取代的黄酮醇的¹H-NMR特征是H-2’，H-6’的化学位移为7.90-8.10（d）（E错）。